内聚力作用与哪个因素关系最密切
A. 基托面积
B. 牙槽嵴形态
C. 基托与黏膜间的密合程度
D. 唾液质量
E. 黏膜厚度

正确答案：D。唾液质量

解析：吸附力的作用：吸附力是两种物体分子之间相互的吸引力，包括附着力和内聚力。内聚力是指同分子之间的内聚力。唾液本身分子之间产生内聚力（黏着力），而使全口义齿获得固位。掌握“全口义齿固位及稳定”知识点。